静态人体测量是测量人体
A. 安静坐姿状态时的尺寸
B. 睡眠状态下的尺寸
C. 安静状态下人体尺寸及重量
D. 静态站立时的尺寸
E. 静止状态各部分的固定尺寸

正确答案：E。静止状态各部分的固定尺寸